以下不属于细菌的特殊结构的是
A. 荚膜
B. 核质
C. 鞭毛
D. 菌毛
E. 芽胞

正确答案：B。核质

解析：细菌的结构包括基本结构和特殊结构。细胞壁、细胞膜、细胞质和核质为基本结构，是细菌所共有的结构。细菌的特殊结构包括荚膜、鞭毛、菌毛及芽胞，为某些细菌所缺乏，而某些细菌所特有的结构。掌握“细菌的特殊结构及检查方法”知识点。